关于胸廓内动脉的描述，错误的是
A. 起自锁骨下动脉第一段
B. 在距前正中线1cm处下行
C. 分为肌膈动脉与腹壁上动脉
D. 腹壁上动脉在腹直肌鞘内与腹壁下动脉吻合
E. 分支分布于胸前壁、心包、膈和乳房等处

正确答案：B。在距前正中线1cm处下行

解析：胸廓内动脉起自锁骨下动脉第一段（A对）。在距胸骨外侧缘（B错，为本题正确答案）约1cm下行。分为肌膈动脉与腹壁上动脉（C对）。腹壁上动脉在腹直肌鞘内与腹壁下动脉吻合（D对）。分支分布于胸前壁、心包、膈和乳房等处（E对）。